属于医疗服务提供方的是
A. 企业
B. 社区
C. 医院
D. 患者
E. 政府

正确答案：C。医院